对铜绿假单胞菌作用最强的氨基苷类抗生素是
A. 卡那霉素
B. 庆大霉素
C. 阿米卡星
D. 妥布霉素
E. 链霉素

正确答案：D。妥布霉素

解析：本题考查氨基苷类抗生素。对铜绿假单胞菌作用最强的氨基苷类抗生素是妥布霉素（D对），其对铜绿假单胞菌的作用是庆大霉素的2〜5倍，且对耐庆大霉素菌株仍有效，适合治疗铜绿假单胞菌所致的各种感染，通常应与能抗铜绿假单胞菌的青霉素类或头孢菌素类药物合用。卡那霉素（A错）对多数常见G⁻菌和结核杆菌有效，但因不良反应较大，疗效不突出，现已被同类其他药取代；目前仅与其他抗结核病药物合用，治疗对第一线药物产生耐药性的结核患者；也可口服用于肝昏迷或腹部术前准备的患者。庆大霉素（B错）是治疗各种G⁻杆菌感染的主要抗菌药，可与青霉素或其他抗生素合用，协同治疗严重的肺炎球菌、铜绿假单胞菌、肠球菌、葡萄球菌或草绿色链球菌感染，现由于庆大霉素耐药和不良反应较大，现选用阿米卡星或依替米星等代替。阿米卡星（C错）对G⁻杆菌和金黄色葡萄球菌均有较强的抗菌活性，但作用较庆大霉素弱。链霉素（E错）对铜绿假单胞菌和其他G⁻杆菌的抗菌活性最低。